空气中具有致癌作用的污染物有
A. BaP、As
B. Hg、Pb
C. SO₂、NO₂
D. CO、O₃
E. 以上都不是

正确答案：A。BaP、As

解析：本题考查空气中具有致癌作用的污染物。BaP即苯并[a]芘，是一种多环芳烃类化合物；As（A对BCDE错）即砷，是一种有毒的重金属污染物，二者都可以通过空气传播，经呼吸道进入人体，对人体健康造成危害，具有致癌作用。